学校健康促进的新模式是
A. 健康促进学校
B. 健康服务中心
C. 绿色学校
D. 学校管理体系
E. 学校教学研究体系

正确答案：A。健康促进学校